从听阈到痛阈的范围是（）dB
A. 100
B. 120
C. 150
D. 180

正确答案：B。120

解析：本题考查听阈到痛阈的范围。人耳所能感受的声音强度范围宽广，以l000Hz声音为例，正常青年人刚能引起音响感觉，即最低可听到的声音强度（听阈)为10⁻¹²W/m²，而声音增大至产生痛感时的声音强度（痛阈)为1W/m²。两者相差10¹²倍。因此引用了对数值来表示声强的等级，称为声强级。通常规定以听阈声强I₀=10⁻¹²W/m²来度量任一声音的强度。L₁=10㏒I/I₀（dB）。根据上述公式可以计算出：从听阈到痛阈的声强范围是120dB（B对ACD错）。在噪声卫生标准制订和噪声控制效果评价时，通常以声音能量的变化为依据。